临床检查牙本质过敏症的最常用的方法为
A. 冷诊
B. 叩诊
C. 酸甜刺激
D. 探针划过敏感点
E. 视诊

正确答案：D。探针划过敏感点

解析：本题考查牙本质敏感症的检查方法。临床检查牙本质过敏症的最常用的方法为探针划过敏感点（D对）。牙本质过敏症（DH）的主要表现是刺激痛；相较于酸、甜、冷、热等化学和温度刺激导致的酸痛，探诊等机械性刺激产生的酸痛更为明显；临床检查牙本质过敏症时最常用的方法是探诊（D对AC错）。叩诊多用于根尖周疾病的检查（B错）。视诊是口腔检查方法的一种，对于检查牙本质过敏症没有意义（E错）。